以下属于社区卫生服务内容的是
A. 重症精神疾病患者急性期治疗和管理
B. 高血压糖尿病等慢性病的诊断
C. 负责处理辖区内发生的突发公共卫生事件
D. 将急重症和疑难症患者转诊到上级医疗机构
E. 对出国出境人员进行必要的免疫接种

正确答案：D。将急重症和疑难症患者转诊到上级医疗机构